治疗痉证肝经热盛证，应首选
A. 羌活胜湿汤
B. 葛根汤
C. 栝蒌桂枝汤
D. 羚角钩藤汤
E. 大定风珠

正确答案：D。羚角钩藤汤

解析：羌活胜湿汤为痉证邪壅经络证的选方，功能祛风散寒燥湿，解肌和营（A错）。葛根汤用于治疗痉证邪壅经络寒邪较甚，项背强急，肢痛拘挛，无汗，病属刚痉者，功能解肌发汗（B错）。栝蒌桂枝汤为痉证邪壅经络风邪偏盛，项背强急，发热不恶寒，汗出，头痛，病属柔痉者，功能和营养津（C错）。痉证肝经热盛证治宜清肝潜阳，息风镇痉，方选羚角钩藤汤中羚角、钩藤清热凉肝，息风止痉；桑叶、菊花清热平肝；鲜地黄、白芍、甘草养阴增液，舒筋缓急；川贝、竹茹清热化痰；茯神平肝宁心安神；为凉肝息风的代表方，治疗痉证肝经热盛证（D对）。大定风珠常合四物汤治疗痉证阴血亏虚证，功能滋阴息风（E错）。